男，40岁。咽痛、咳嗽1个月余，半个月前多次肌注青霉素治疗好转，但近5天来发生寒战发热，体温达39.2~40℃，伴谵妄，同时右臀注药物处胀痛较剧。查体：呼吸正常，血压96/58mmHg，咽部充血，扁桃体稍肿大，未及浅表肿大淋巴结，心律齐，肺部呼吸音粗糙，无啰音，腹平软，无压痛，肝、脾未触及，右臀部肿胀，皮肤发光，压痛明显。白细胞16x10⁹/L，有核左移。为明确该患者的病原菌，最有意义的检查是
A. 血培养
B. 痰培养
C. 咽拭培养
D. 尿培养
E. 骨髓检查

正确答案：A。血培养